桑白皮与葶苈子除均能泻肺平喘外，又均能
A. 清心定惊
B. 和胃降逆
C. 清肠通便
D. 化痰止咳
E. 利水消肿

正确答案：E。利水消肿

解析：本题考查的是桑白皮与葶苈子的功效。桑白皮与葶苈子除均能泻肺平喘外，又均能利水消肿（E对）。桑白皮：【功效】泻肺平喘，利水消肿。葶苈子：【功效】泻肺平喘，利水消肿。天竺黄：【功效】清热化痰，清心定惊（A错）。枇杷叶：【功效】清肺止咳，降逆止呕。枇杷叶则兼润肺燥，善治燥咳；又能和胃降逆（B错）止呕，治胃热呕吐。胖大海：【功效】清宣肺气，清肠通便（C错）。紫菀：【功效】润肺下气，化痰止咳（D错）。